儿童膳食中，糖类所供给的能量比例，婴儿期一般占总能量的
A. 35%～45%
B. 40%～45%
C. 40%～50%
D. 50%～55%
E. 55%～65%

正确答案：C。40%～50%

解析：儿童膳食中，糖类所供给的能量比例，婴儿期一般占总能量的40%～50%，2岁以上应占总能量的55%～65%。掌握“儿童营养基础”知识点。